每日服用1次的抑酸药是
A. 奥美拉唑
B. 地塞米松
C. 枸橼酸铋钾
D. 阿托品
E. 三硅酸镁

正确答案：A。奥美拉唑

解析：本题考查抑酸药的给药频次。奥美拉唑（A对）为质子泵抑制剂，每日服用一次。